在队列研究中，估计某因素与某疾病关联强度的指标是
A. 总人群中该病的发病率
B. 暴露人群中该病的发病率
C. 总人群中可疑危险因素的暴露率
D. OR
E. RR

正确答案：E。RR

解析：本题考查相对危险度。在队列研究中，估计某因素与某疾病关联强度的指标是RR（相对危险度）（E对C错）。总人群中该病的发病率（A错）、暴露人群中该病的发病率（B错）是反映疾病对人群健康影响和描述疾病分布状态。OR（比数比）（D错）表示病例组和对照组中的暴露比例与非暴露比例的比值之比，是反映疾病与暴露之间关联强度的指标。